26岁初孕妇，现妊娠40周，近半月头痛、眼花，今晨出现剧烈头痛并呕吐2次来院就诊。测血压180/110mmHg。最有参考价值的病史是
A. 既往无头痛史
B. 既往血压正常
C. 有高血压家族史
D. 有患病毒性肝炎史
E. 有多次泌尿系统感染史

正确答案：B。既往血压正常

解析：26岁初孕妇，妊娠40周，出现头痛、眼花、呕吐（重度子痫前期可有持续头痛或视觉障碍或其它脑神经症状），血压180/110mmHg（重度子痫前期收缩压≥160mmHg和（或）舒张压≥110mmHg）应考虑妊娠期高血压疾病，按其分期为重度子痫前期。慢性高血压、妊娠期高血压疾病史及其家族史（注意单纯的高血压家族史（C错）并不是妊娠期高血压疾病的高危因素）以及慢性肾炎等都是妊娠期高血压疾病的高危因素。该患者最有参考价值的病史是既往血压正常（B对）。虽然重度子痫前期有持续性头痛的临床表现，但既往无头痛史（A错）对妊娠期高血压疾病的诊断并不提供参考价值。患病毒性肝炎史（D错）和多次泌尿系统感染史（E错）与妊娠期高血压疾病无明显关系。